急性毒性试验一般观察的时间是
A. 1小时
B. 1天
C. 1周
D. 2周
E. 1个月

正确答案：D。2周